免疫复合物沉积最重要的因素是
A. 19s可溶性的免疫复合物
B. CIC与组织结合的能力
C. 补体的激活
D. 局部血管的动力学
E. Ag在体内长期存在

正确答案：C。补体的激活

解析：Ⅲ型超敏反应是由免疫复合物沉积于局部或全身多处毛细血管基底膜后，通过激活补体，并在中性粒细胞、血小板、嗜碱性粒细胞等效应细胞参与下，引起的以充血水肿、局部坏死和中性粒细胞浸润为主要特征的炎症反应和组织损伤。掌握“Ⅱ型、Ⅲ型、Ⅳ型超敏反应”知识点。